关于氢氯噻嗪的适应证，不适合的是
A. 尿崩症
B. Ⅰ级高血压
C. 糖尿病伴Ⅰ级高血压
D. 心源性水肿
E. 特发性高尿钙

正确答案：C。糖尿病伴Ⅰ级高血压

解析：氢氯噻嗪临床应用于：①水肿：是轻、中度心源性水肿的首选药（D对）②高血压：轻、中度高血压可单用或与其他利尿药合用（B对）③尿崩症（A对）④特发性高钙尿症和肾结石（E对）。氢氯噻嗪的不良反应：对糖代谢及脂质代谢出现不良影响，如高血糖、高血脂，故高血压患者合并有糖尿病或高脂血症者慎用（C错，为本题正确答案）。